根据《中华人民共和国药品管理法》，由国家药品监督管理部门会同国家中医药管理部门制定的是
A. 药物临床试验机构资格认定办法
B. 中药品种保护制度
C. 地区性民间习用药材管理办法
D. 首次在中国销售的药品的检验费收缴办法
E. 首次在中国销售的药品的检验费项目

正确答案：C。地区性民间习用药材管理办法

解析：本题考查地区性民间习用药材管理办法的制定机构。根据《中华人民共和国药品管理法》，由国家药品监督管理部门会同国家中医药管理部门制定的是地区性民间习用药材管理办法（C对）。实施审批管理的中药材、中药饮片品种目录由国务院药品监督管理部门会同国务院中医药主管部门制定。药物临床试验机构资格认定办法（A错）由国家药品监督管理部门、国务院卫生行政部门共同制定。中药品种保护制度（B错）由国务院制定。首次在中国销售的药品的检验费收缴办法（D错）由国务院财政部门会同国家药品监督管理部门制定。